应激的心理反应不包括
A. 行为反应
B. 情绪反应
C. 认识反应
D. 神经反应
E. 自我防御反应

正确答案：D。神经反应

解析：本题考查心理应激。应激的心理反应不包括神经反应（D错，为本题正确答案）。应激的心理反应包括：①认识反应（C对）；②情绪反应（B对）；③行为反应（A对）；④自我防御反应（E对）。